克匿格征属于
A. 牵张反射
B. 浅反射
C. 病理反射
D. 脑膜刺激征
E. 自主神经反射

正确答案：D。脑膜刺激征